心力衰竭防治的病理生理基础是
A. 限制输液
B. 改善心肌舒缩功能并调整前后负荷
C. 首先输氧
D. 使用血管扩张剂，降低心脏负荷
E. 防治病因

正确答案：B。改善心肌舒缩功能并调整前后负荷

解析：心力衰竭防治的病理生理基础包括防治病因、消除诱因、调整神经-体液系统失衡及干预心室重塑、减轻心脏的前负荷和后负荷、改善心肌的收缩和舒张性能。本题中所有选项均为心衰防治的病生基础或具体措施，但B选项描述较其他选项更为全面（B对）。